中医学认为，风湿性心脏瓣膜病多虚实夹杂，其标实是指
A. 气虚、阳虚或阴虚
B. 气虚、血虚或阴虚
C. 气虚、血虚或阳虚
D. 水饮内停，瘀血内阻
E. 风寒湿邪，瘀血内阻

正确答案：D。水饮内停，瘀血内阻

解析：中医学认为，风湿性心脏瓣膜病属本虚标实，虚指气血阴阳亏虚，实以瘀血、水饮为主。血液的正常运行全赖心气推动。心气不足，鼓动无力，则血行不畅，形成瘀血，导致气虚血瘀发为此病；久病之后，阳气虚弱，不能温养心脉，心阳虚衰，累计肾阳，肾不能气化水湿而生水饮，饮邪上犯凌心则心悸，射肺则咳喘，泛溢肌肤则水肿（D对）。